属于下颌运动的基本形式的是
A. 侧向运动
B. 言语运动
C. 吞咽运动
D. 呼吸运动
E. 叩齿运动

正确答案：A。侧向运动

解析：本题考查下颌运动基本形式。属于下颌运动的基本形式的是侧向运动（A对）。下颌运动基本形式：开闭口运动、前后运动及侧方运动。下颌功能运动：咀嚼运动、吞咽运动（C错）、言语运动（B错）及叩齿运动（E错）。